氧化锌丁香油水门汀结固时间过长，增加下列哪一种成份可加快其结固
A. 松香
B. 氧化铝
C. 硬脂酸锌或醋酸锌
D. 橄榄油

正确答案：C。硬脂酸锌或醋酸锌

解析：本题考查氧化锌丁香油水门汀的组成及各成分的作用。硬脂酸锌有增塑性，加速固化的作用。醋酸锌有加速固化，增加强度的作用。所以硬脂酸锌或醋酸锌（C对）都有加快氧化锌丁香油水门汀结固的作用。松香（A错）（即松脂）的作用是增加氧化锌丁香油水门汀的黏性与韧性，减少脆性。氧化铝（B错）不是氧化锌丁香油水门汀的成分，而氧化锌是氧化锌丁香油水门汀的成分，有消毒收敛作用。橄榄油（D错）的作用是增加氧化锌丁香油的黏性与韧性。